根据《药品不良反应报告和监测管理办法》，进口药品自首次获准进口之日起5年内，应报告该药品的
A. 已知的药品不良反应
B. 常见的药品不良反应
C. 罕见的药品不良反应
D. 所有的药品不良反应
E. 新的和严重的药品不良反应

正确答案：D。所有的药品不良反应

解析：本题考查药品不良反应报告。根据《药品不良反应报告和监测管理办法》，进口药品自首次获准进口之日起5年内，应报告该药品的所有的药品不良反应（D对）。《药品不良反应报告和监测管理办法》第三章报告与处置第二节个例药品不良反应第二十条：新药监测期内的国产药品应当报告该药品的所有不良反应；其他国产药品，报告新的和严重的不良反应（E错）。进口药品自首次获准进口之日起5年内，报告该进口药品的所有不良反应；满5年的，报告新的和严重的不良反应。